“先安未受邪之地”属
A. 未病先防
B. 既病防变
C. 二者均是
D. 二者均非

正确答案：B。既病防变

解析：本题考查的是既病防变的基本措施。“先安未受邪之地”属既病防变（B对）。既病防变，指在疾病发生之后，早期诊断，早期治疗，见微知著，防微杜渐，以防止疾病的发展和传变。既病防变的基本原则：1.早期诊治：只有掌握疾病发生发展及其传变规律，才能做到早期诊治，阻止发展。2.控制疾病的传变：防止传变是在掌握疾病的发生发展及其传变规律的基础上，采取截断疾病传变途径和“先安未受邪之地”的方法，防止疾病的发展或恶化。未病先防（A错），即是在疾病发生之前，做好各种预防工作，以防止疾病的发生。疾病的发生，关系到邪正两个方面的因素。邪气是导致疾病发生的重要条件，而正气不足是疾病发生的内在原因，外邪通过内因而起作用。